下列哪项药物适用于阴虚肺燥有热之干咳少痰、咳血或咽干音哑
A. 北沙参
B. 墨旱莲
C. 女贞子
D. 百合
E. 石斛

正确答案：A。北沙参

解析：北沙参甘润微苦微寒，能补肺阴，兼能清肺热，适宜用于阴虚肺燥有热之干咳少痰、久咳劳嗽或咽干音哑（A对）。墨旱莲甘寒，入肝肾经，能补肝肾之阴，固齿乌须发，常用于肝肾阴虚所致牙齿松动，须发早白，眩晕耳鸣，腰膝酸软不适宜用于阴虚肺燥有热之干咳少痰、久咳劳嗽或咽干音哑（B错）。女贞子味甘性凉，功善滋补肝肾，又兼清虚热，补中有清不适宜用于阴虚肺燥有热之干咳少痰、久咳劳嗽或咽干音哑（C错）、百合微寒，作用平和，能补肺阴，兼能清肺热，有养阴清肺，润燥止咳之效不适宜用于阴虚肺燥有热之干咳少痰、久咳劳嗽或咽干音哑（D错）。石斛甘而微寒，入胃经，长于滋养胃阴，生津止渴，兼能清胃热不适宜用于阴虚肺燥有热之干咳少痰、久咳劳嗽或咽干音哑（E错）综上可知适用于阴虚肺燥有热之干咳少痰、咳血或咽干音哑的中药是北沙参。